胃溶性包衣材料是
A. CAP
B. EC
C. PEG400
D. HPMC
E. CCMC-Na

正确答案：D。HPMC

解析：本题考查片剂的包衣。羟丙甲纤维素（HPMC）（D对）属于胃溶性包衣材料；CAP（醋酸纤维素酞酸酯）（A错）为肠溶型包衣材料；EC（乙基纤维素）（B错）为不溶性包衣材料；PEG400（聚乙二醇400）（C错）常用作溶剂、助溶剂，不用作包衣材料；CCMC-Na（交联羧甲基纤维素钠）（E错）为崩解剂。